女，33岁，昨晚吃街边烧烤后于今晨3时突然畏寒、高热、呕吐、腹痛、腹泻，腹泻共4次，开始为稀水样便，继之便中带有粘液和脓血。在未做实验室检查的情况下，该患者可能的诊断是
A. 急性轻型细菌性痢疾
B. 急性普通型细菌性痢疾
C. 中毒型细菌性痢疾
D. 慢性细菌性痢疾急性发作
E. 慢性迁延型细菌性痢疾急性发作

正确答案：B。急性普通型细菌性痢疾

解析：33岁女性患者，食用街边烧烤后（致病菌经粪口传播可能性大）突发畏寒、高热、呕吐、腹痛腹泻，腹泻共4次，开始为稀水样便，继之便中带有粘液和脓血（急行军礼普通型典型临床表现），在未做实验室检查的情况下，该患者可能的诊断是急性普通型细菌性痢疾（B对）。急性轻型细菌性痢疾（A错）全身毒血症状轻微，可无发热或仅低热，表现为急性腹泻，稀便有粘液但无脓血。中毒性菌痢（C错）多见多见于2～7岁儿童，特点是起病急，全身中毒症状较重，有呼吸或循环衰竭，肠道症状轻微。慢性菌痢（DE错）是指菌痢病程＞2个月。